男，52岁。乏力、腹胀1年，加重伴腹痛2天。慢性乙型肝炎病史12年。查体T38.8℃，前胸可见数个蜘蛛痣，腹部饱满，全腹弥漫压痛及反跳痛，移动性浊音阳性。最可能的诊断是
A. 腹膜转移癌
B. 结核性腹膜炎
C. 肝癌破裂
D. 上消化道穿孔
E. 自发性腹膜炎

正确答案：E。自发性腹膜炎

解析：中年男性患者，慢性乙型肝炎病史12年，前胸见数个蜘蛛痣（提示肝硬化），腹部饱满，移动性浊音阳性（提示肝硬化合并腹水），T38.8℃（正常值为36～37℃），全腹弥漫压痛及反跳痛（腹膜刺激症状），结合患者病史、体查，最可能的诊断为自发性腹膜炎（E对）。腹膜转移癌（A错）多继发于肝、胃、结肠、胰腺和卵巢等的恶性肿瘤，腹水为其最常见的症状，且出现较早，查体可触及腹部多发性包块，无蜘蛛痣等肝功能减退的症状。结核性腹膜炎（B错）多继发于肺结核，以腹痛和低热、盗汗等结核中毒症状为主要表现，腹部触诊常有揉面感，腹水较少见。肝癌破裂（C错）为原发性肝细胞癌的严重并发症之一，发病急，病情凶险，常表现为突发的剧烈上腹部疼痛并迅速波及全腹，腹膜刺激征、移动性浊音阳性，腹腔穿刺可抽出不凝血，一般无发热。上消化道穿孔（D错）起病急，变化快，病人大多有消化性溃疡病史，常表现为突发的上腹部剧烈疼痛，腹痛迅速波及全腹，听诊肠鸣音减弱或消失，早期无发热，不会出现蜘蛛痣等表现。